生育是指
A. 使生命得以延续
B. 受精卵的形成是生育地开始
C. 子宫是孕育胎儿的地方
D. 分娩的过程
E. 指从受精卵开始至分娩的全过程

正确答案：E。指从受精卵开始至分娩的全过程

解析：本题考查生育的概念。生育是指从受精卵开始至分娩的全过程（E对ABCD错），生育之前做好充分的准备，消除隐患，尽可能避免导致出生缺陷的影响因素，创造优生优育的精神和物质条件，对于提高出生人口素质具有积极主动的作用。